情感倒错是指
A. 情感后动增强、病态的喜悦
B. 对外界一切均不能引起兴趣
C. 病人情绪容易引起波动
D. 情感体验与思维内容、外界刺激不相协调
E. 对外界任何刺激均缺乏相应情感反应

正确答案：D。情感体验与思维内容、外界刺激不相协调